有非常明显的季节性传染病主要是
A. 经节肢动物传播传染病
B. 呼吸道传染病
C. 肠道传染病
D. 性病

正确答案：A。经节肢动物传播传染病

解析：本题考查有非常明显的季节性传染病。经节肢动物传播的传染病（A对）有明显的季节性，其病例消长与传播媒介的活动季节一致。呼吸道传染病（B错）和肠道传染病（C错）一年四季均发病，但仅在一定月份发病率升高。性病（D错）的发病不具有季节性。